男，72岁。右手震颤伴动作缓慢6年，翻身困难1年，诊断为帕金森病。有青光眼和轻度肾功能不全病史，无消化性溃疡史。服用复方左旋多巴时症状改善明显，近1年来疗效减退，单剂疗效仅3小时。为改善症状，最适合增加的药物是
A. 溴隐亭
B. 金刚烷胺
C. 司来吉兰
D. 苯海索
E. 苯甲托品

正确答案：C。司来吉兰

解析：老年男性患者，右手震颤伴动作缓慢6年，诊断为帕金森病。有青光眼（禁用抗胆碱类药，抗胆碱类药会增加眼内压，加重青光眼症状）和轻度肾功能不全病史，服用复方左旋多巴时症状改善明显，近一年来疗效减退，单剂疗效仅3小时，为左旋多巴的“剂末效应”。司来吉兰能增加及延长左旋多巴的效果，所以可减少左旋多巴的剂量。与左旋多巴并用时，本药特别能减少帕金森病的波动，因此最适合增加的药物是司来吉兰（C对）。溴隐亭（A错）是帕金森患者的治疗药物，但对左旋多巴治疗疗效不佳的患者价值有限。金刚烷胺（8版药理P135）（B错）可加强多巴胺功能，但作用持续时间短，连用6～8周后疗效逐渐减弱，且亦有抗胆碱作用，不宜选用。苯海索（D错）（8版药理P135）苯甲托品（E错）（8版药理学P136）、为抗胆碱能药物，也是帕金森患者的治疗药物，但会增加眼内压，加重青光眼症状，不宜选用。